女，32岁。停经56天，行人工流产负压吸宫术时突然出现面色苍白，大汗淋漓，查：BP：70/50mmHg，P：60次/分。此时应暂停手术并给予
A. 阿托品
B. 异丙嗪
C. 氯丙嗪
D. 哌替啶
E. 哌替啶，异丙嗪

正确答案：A。阿托品

解析：该患者为育龄期妇女，停经56天，在人工流产负压吸宫术时突然出现面色苍白，大汗淋漓，低血压，心动过缓（人工流产综合反应是指手术时疼痛或局部刺激，使手术者在术中或术毕出现恶心呕吐、心动过缓、心律不齐、面色苍白、头昏、胸闷、大汗淋漓，严重者甚至出现血压下降、昏厥、抽搐等迷走神经兴奋症状），最可能的诊断是人工流产综合反映。发现症状应立即停止手术，给予吸氧，一般能自行恢复。患者病情严重应可加阿托品（A对）0.5～1mg静脉注射。哌替啶（D错）、氯丙嗪（C错）、异丙嗪（BE错）可组成冬眠合剂用于解痉减压，控制子痫抽搐，但不用于人工流产综合反应的治疗。